蛋白质-热能营养不良的少见并发症
A. 营养性贫血
B. 呼吸道感染
C. 腹泻
D. 自发性低血糖
E. 佝偻病

正确答案：E。佝偻病

解析：蛋白质－热能营养不良患儿由于营养失调，常出现各种并发症：缺乏铁、叶酸、维生素B12、蛋白质等造血原料时可出现营养性贫血（A对）；缺乏锌等微量元素且免疫力低下，易患各种感染（B对）；婴儿腹泻常迁延不愈，加重营养不良，形成恶性循环（C对）；除此之外还可并发自发性低血糖（D对）。蛋白质－热能营养不良时常有维生素缺乏，尤其是脂溶性维生素A、D，但在营养不良时维生素D缺乏的症状（佝偻病）不明显，在恢复期生长发育加快时症状才较为突出（E错，为本题正确答案）。